患者，男，65岁。突感上腹部剧烈疼痛，取硝酸甘油片含服，未能缓解。查体：脸色青白，血压80/60mmHg（10.67/7.98kPa），除心率140次/分钟外，心肺听诊无异常，腹平软，无压痛反跳痛，肠鸣音存在。应首先考虑的是
A. 胃痉挛
B. 胃穿孔
C. 心绞痛
D. 急性胰腺炎
E. 心肌梗死

正确答案：E。心肌梗死

解析：患者，老年男性，突感上腹部剧烈疼痛，取硝酸甘油片含服，未能缓解查体：脸色青白，血压下降，心率失常，心肺听诊无异常，腹平软，无压痛反跳痛，肠鸣音存在，考虑心肌梗死（E对）。胃痉挛的症状主要表现为急性阵发性的上腹部剧痛，可伴有恶心、呕吐、乏力等症状，可能会出现腹泻、大便次数增多或水样便等症状。胃痉挛多在受凉或进食辛辣刺激生冷的食物时诱发，如果患者既往有消化性溃疡、慢性胃炎等消化道系统疾病史，出现胃痉挛，且症状持续不缓解，甚至伴有发热、腹部拒按，应立即急诊就诊（A错）。胃穿孔有胃病史，腹痛伴恶心呕吐，血压下降，腹部硬如木板等（B错）。心绞痛取硝酸甘油片含服可缓解（C错）。急性胰腺炎常常见于大量饮酒—国外最常见病因。腹痛—主要表现和首发症状，常饱餐和饮酒后突然发作，为中上腹剧痛，呈持续性，可放射至腰背部，呕吐后腹痛不缓解。低血压或休克—常见于出血坏死型病人。腹膜炎水肿性胰腺炎—多局限于上腹部，常无肌紧张；坏死性—腹部压痛明显，伴肌紧张、反跳痛，肠鸣音减弱或消失；两侧胁腹部皮肤呈暗灰蓝色。电解质紊乱：呕吐频繁—代谢性碱中毒。出血坏死型—脱水和代谢性酸中毒。低钙血症—手足抽搐。血清（胰）淀粉酶：起病后2～12小时开始升高，48小时下降，持续3～5日（D错）。